吗啡和阿司匹林均不具有的不良反应是
A. 诱发或加重支气管哮喘
B. 诱发或加重溃疡病
C. 便秘
D. 凝血障碍
E. 锥体外系症状

正确答案：E。锥体外系症状

解析：吗啡的不良反应：①呼吸抑制；②胃肠道症状；③尿潴留；④成瘾。阿司匹林的不良反应：①过敏反应；②上腹不适、恶心、食欲不振；③上消化道出血；④皮肤出血点；⑤对外科手术的影响；⑥诱发哮喘。吗啡和阿司匹林均不具有的不良反应为椎体外系症状（E错，为本题正确答案）。